不能通过输血传播的病原是
A. 单纯疱疹病毒
B. EB病毒
C. 巨细胞病毒
D. 肝炎病毒
E. HIV

正确答案：A。单纯疱疹病毒

解析：单纯疱疹病毒（八版微生物学P296）（A错，为本题正确答案）有两种血清型，1型主要通过密切接触感染，2型主要通过性接触传播或新生儿经母体生殖道感染。而EB病毒（B对）、巨细胞病毒（C对）、肝炎病毒（D对）、HIV（E对）均可通过血液传播。